心脏性猝死最早出现的是
A. 晕厥
B. 呼吸停止
C. 瞳孔散大
D. 脉搏血压测不到
E. 抽搐

正确答案：D。脉搏血压测不到

解析：心脏性猝死是指由于心脏原因引起的无法预料的自然死亡，常以突然意识丧失为表现，若检查患者无反应，无呼吸或仅是喘息，不能在10秒内明确感觉到脉搏，应立即开始心肺复苏（D对ABCE错）。